不能屈髋关节的肌是
A. 髂腰肌和阔筋膜张肌
B. 髂腰肌和缝匠肌
C. 缝匠肌和股直肌
D. 股直肌和髂腰肌
E. 股二头肌和股薄肌

正确答案：E。股二头肌和股薄肌

解析：股二头肌和股薄肌（E错，为本题正确答案），前者屈膝、伸髋、使已屈的膝关节旋外，后者使髋关节内收和旋外，均不能屈髋关节。